关于处方药与非处方药分类管理的说法，正确的是
A. “双跨”药品的处方药部分和非处方药部分的标签，说明书，商品名应相同
B. 自动售药机可以销售所有非处方药品
C. 非处方药可以在大众媒介上进行广告宣传，但广告内容必须经过审查批准，禁止随意夸大或篡改
D. 处方药和非处方药应分别在包装上印制国家指定的专有标识Rx和OTC

正确答案：C。非处方药可以在大众媒介上进行广告宣传，但广告内容必须经过审查批准，禁止随意夸大或篡改

解析：本题考查的是非处方药的广告管理。关于处方药与非处方药分类管理的说法，正确的是非处方药可以在大众媒介上进行广告宣传，但广告内容必须经过审查批准，禁止随意夸大或篡改（C对）。非处方药的广告管理：非处方药是方便个人消费者自我保健、治疗的药品，消费者应详细了解其治疗功效。因此，非处方药可以在大众媒介上进行广告宣传，但广告内容必须经过审查、批准，不能任意夸大或擅自篡改。其目的是正确引导个人消费者科学、合理地进行自我药疗。“双跨”药品既能按处方药管理，又能按非处方药管理，因此必须分别使用处方药和非处方药两种标签、说明书，其处方药和非处方药的包装颜色应当有明显区别（A错）。非人工自助售药设备不得销售除乙类非处方药外的其他药品（B错）。非处方药的包装要有国家规定的专有标识OTC，处方药包装无专有标识（D错）。